食品安全生产经营的监督管理内容不包括
A. 食品生产经营许可
B. 风险分级管理
C. 食品召回
D. 抽样检验
E. 食品安全性评价

正确答案：E。食品安全性评价

解析：本题考查食品安全生产经营的监督管理内容。食品安全监督管理的内容包括：1.重点监督管理内容：食品安全年度监督管理计划应当将下列事项作为监督管理的重点：①专供婴幼儿和其他特定人群的主辅食品；②保健食品生产过程中的添加行为和按照注册或者备案的技术要求组织生产的情况，保健食品标签、说明书以及直传材料中有关功能宣传的情况；③发生食品安全事故风险较高的食品生产经营者；④食品安全风险监测结果表明可能存在食品安全隐患的事项；2.常规监督管理内容：县级以上人民政府食品药品监督管理、质量监督部门有权采取下列措施，对生产经营者的清况进行监督检查：①进入生产经营场所实施现场检查；②对生产经营的食品、食品添加剂、食品相关产品进行抽样检验（D对）；③查阅复制有关合同票据账簿以及其他有关资料；④查封扣押有证据证明不符合食品安全标准或者有证据证明存在安全隐患以及用于违法生产经营的食品、食品添加剂、食品相关产品；⑤查封违法从事生产经营活动的场所；3.食品生产经营许可（A对）；4.风险分级管理（B对）；5.食品召回（C对）。食品安全性评价（E错，为本题正确答案）不是食品安全监督管理的内容。